不替换的牙是
A. 切牙
B. 尖牙
C. 前磨牙
D. 磨牙
E. 双尖牙

正确答案：D。磨牙

解析：本题考查牙齿的替换。不替换的牙是磨牙（D对）。磨牙只有恒牙列才存在，不会被替换；而乳牙会被替换。在乳牙列中，乳中切牙、乳侧切牙、乳尖牙、第一乳磨牙与第二乳磨牙的根方，存在恒牙列的中切牙、侧切牙（A错）、尖牙（B错）、第一前磨牙与第二前磨牙（CE错）的牙胚，并会逐渐被恒牙的牙胚吸收，最终恒牙萌出、乳牙脱落。